关于维生素C注射液的含量测定，叙述正确的有
A. 以中性乙醇作溶剂
B. 滴定前先加入丙酮
C. 用碘滴定液滴定
D. 用淀粉作指示剂
E. 维生素C的含量应为标示量的99.0%～101.0%

正确答案：B、C、D。滴定前先加入丙酮；用碘滴定液滴定；用淀粉作指示剂

解析：本题考查碘量法。《中国药典》记载维生素C的含量测定方法为：精密量取本品适量，加水（A错）15ml与丙酮（B对）2ml，摇匀，放置5分钟，加稀醋酸4ml与淀粉指示液（D对）1ml，用碘滴定液（C对）（0.05mol/L）滴定，至溶液显蓝色并持续30秒钟不褪色。另外，《中国药典》中规定维生素C的含量应为标示量的90.0%～110.0%（E错）。